支配胸锁乳突肌的神经是
A. 面神经
B. 副神经
C. 三叉神经
D. 舌咽神经
E. 无

正确答案：B。副神经

解析：支配胸锁乳突肌的神经是副神经（B对）。面神经（A错）的特殊内脏运动纤维支配面部表情肌。三叉神经（C错）的特殊内脏运动纤维支配咀嚼肌。舌咽神经（D错）特殊内脏运动纤维支配茎突咽肌。